免疫耐受是指
A. 指抗原特异性的免疫无应答
B. 指抗体特异性的免疫无应答
C. 指抗原非特异性的免疫无应答
D. 指抗体非特异性的免疫无应答
E. 指抗原特异性的免疫应答

正确答案：A。指抗原特异性的免疫无应答

解析：免疫耐受是指抗原特异性的免疫无应答。掌握“免疫耐受”知识点。